根据《药品包装、标签和说明书管理规定（暂行）》，下列所述属于药品内包装标签必须标注的内容是
A. 药品的用法用量
B. 药品的功能主治或适应症
C. 药品的生产企业
D. 药品生产日期
E. 药品名称、规格及生产批号

正确答案：E。药品名称、规格及生产批号

解析：本题考查药品的内标签。药品内包装标签必须标注的内容是药品名称、规格及生产批号（E对）。药品内标签是指直接接触药品包装的标签。内包装标签可根据其尺寸的大小，应当尽可能包含药品通用名称、适应症或者功能主治、规格、用法用量、贮藏、生产日期、生产批号、有效期、生产企业等内容。包装尺寸过小无法全部标明上述内容的，至少应当标注药品通用名称、规格、产品批号、有效期等内容。药品的用法用量（A错）、药品的功能主治或适应症（B错）、药品的生产企业（C错）、药品生产日期（D错）不属于必须标注的内容。